下列关于真菌及其毒素食物中毒的说法错误的是
A. 中毒的主要原因是被真菌污染的食品
B. 发病率较高
C. 死亡率较髙
D. 一般烹调方法加热处理即可破坏食品中的真菌毒素
E. 发病的季节性及地区性均较明显

正确答案：D。一般烹调方法加热处理即可破坏食品中的真菌毒素